滤池的工作周期为
A. 清洗期、成熟期、过滤期
B. 成熟期、过滤期、清洗期
C. 过滤期、成熟期、清洗期
D. 过滤期、清洗期、成熟期
E. 成熟期、清洗期、过滤期

正确答案：B。成熟期、过滤期、清洗期

解析：本题考查滤池的工作周期。滤池工作可分三期：①成熟期：此时滤料很清洁，过滤效果较差，需降低滤速或实行初滤排水；②过滤期：此时滤料表面已吸附了一层絮凝体或已形成生物膜，净水效果良好；③清洗期（B对ACDE错）：在过滤过程中，滤层孔隙不断减小，水流阻力越来越大，终因产水量大减，或出水水质欠佳，而需停止过滤进行反冲洗。